牙槽嵴吸收程度二级的表现
A. 牙槽嵴吸收达基骨，牙槽嵴后部形成凹陷者
B. 高度明显降低，牙槽嵴大部分吸收而低平者
C. 牙槽嵴吸收较少，有一定的高度和宽度，形态丰满者
D. 高度降低，尤其是宽度明显变窄，呈刀刃状的牙槽嵴
E. 以上均不对

正确答案：D。高度降低，尤其是宽度明显变窄，呈刀刃状的牙槽嵴

解析：一级：牙槽嵴吸收较少，有一定的高度和宽度，形态丰满者；二级：高度降低，尤其是宽度明显变窄，呈刀刃状的牙槽嵴；三级：高度明显降低，牙槽嵴大部分吸收而低平者；四级：牙槽嵴吸收达基骨，牙槽嵴后部形成凹陷者。掌握“牙列缺失后的病因及影响”知识点。